药物在固体分散物中的分散状态包括
A. 分子状态
B. 胶态
C. 分子胶囊
D. 微晶
E. 无定形

正确答案：A、B、D、E。分子状态；胶态；微晶；无定形

解析：本题考查药物在固体分散体中的分散状态。药物在固体分散体中以分子（A对）、胶态（B对）、微晶（D对）或无定形（E对）状态分散。分子胶囊（C错）为包合物，是主分子将客分子容纳在内。